瘢痕性幽门梗阻最突出的临床表现是
A. 消瘦
B. 呕吐胃内容物及胆汁
C. 移动性浊音阴性
D. 呕吐宿食，不含胆汁
E. 持续呃逆

正确答案：D。呕吐宿食，不含胆汁

解析：瘢痕性幽门梗阻为并发于反复发作的胃幽门、幽门管或十二指肠球部溃疡的瘢痕性狭窄，当瘢痕引起严重狭窄时，食物无法通过幽门下行而长时间积聚于胃内，可于第二天出现腹痛和反复呕吐，由于食物未进入肠内与胆汁混合，故呕吐物常为不含胆汁的宿食（D对），由于此病常在长期反复发作消化道溃疡的前提下发生，故可能存在消瘦的表现但消瘦（A错）多为肿瘤性疾病或长期慢性消耗性疾病所共有表现，不具有特异性。呕吐胃内容物及胆汁（B错）说明病变发生在胆总管开口以下食物已与胆汁混合，也多见于胃空肠吻合术后并发的输出袢梗阻及慢性不全性输入袢梗阻。移动性浊音阴性（C错）为可排除腹腔积液的体征。持续性呃逆(E错）可见于术后并发症、膈下积液或感染，非本病特征性临床表现。